在2003年，突如其来的SARS疫情袭击了我国，并在一段时间内造成了国民的普遍恐慌。为了有效地应对SARS，我国政府出台了《突发公共卫生事件应急反应条例》，在全国范围内成立了防非典指挥部，国家重点科研院所和实验室启动了SARS研究项目，全国各级疾控中心迅速开展了相应的流行病学调查工作。经过全国人民的共同努力，SARS最终得到了有效的控制。我国能在较短时间内有效控制SARS的最为关键原因是
A. 迅速而及时地开展了SARS相关研究
B. 实现了对SARS传染源的有效控制
C. 建立了高效率的SARS防控组织
D. 对人员进行了快速培训
E. 制定和实施了全方位的SARS防治综合策略和措施

正确答案：E。制定和实施了全方位的SARS防治综合策略和措施